中国营养学会推荐妊娠期妇女膳食钙RNI在非孕妇女基础上，孕中期增加
A. 100mg/d
B. 200mg/d
C. 300mg/d
D. 400mg/d
E. 500mg/d

正确答案：B。200mg/d

解析：本题考查中国营养学会推荐妊娠期妇女膳食钙RNI在非孕妇女基础上，孕中期应增加的量。中国营养学会推荐妊娠期妇女膳食钙RNI在非孕妇女800mg/d的基础上，孕中期增加200mg/d（B对ACDE错）。